疝手术病人入院时血压150/96mmHg，针对此血压值正确的处理是
A. 术前用降压药
B. 术前不用降压药
C. 术中用降压药
D. 术后不用降压药
E. 术前术后均用降压药

正确答案：B。术前不用降压药

解析：患者血压在160/100mmHg以下，术前无需服用降压药就可以手术（AE错B对）；术中用降压药（C错）应根据术中血压变化情况决定，而不是根据入院时的血压值；由于病人入院血压为1级高血压，且病因未明，为终身性疾病，所以术后需服用降压药（D错）。